化学毒物在器官和组织中的分布最主要受哪项因素影响
A. 化学毒物与器官的亲和力
B. 血流量
C. 特定部位的屏障作用
D. 器官和组织所在部位

正确答案：A。化学毒物与器官的亲和力

解析：本题考查化学毒物在器官和组织中的分布最主要的影响因素。化学毒物在器官和组织中的分布最主要受化学毒物与器官的亲和力（A对BCD错）影响。在毒物吸收后，随着时间的推移，分布受到化学毒物经膜扩散速率及其与组织器官亲和力的影响，发生再分布。